下列哪项不是修复前准备与处理的内容
A. 修复前口腔的一般处理
B. 余留牙的保留与拔除
C. 口腔软组织及牙槽骨的处理
D. X线检查
E. 修复前正畸治疗

正确答案：D。X线检查

解析：本题考查修复前的准备与处理。X线检查（D错，为本题正确答案）不属于修复前准备及处理的内容。修复前的准备及处理包括：1.修复前口腔的一般处理（A对），如处理急性症状、保证良好的口腔卫生、拆除不良修复体、治疗和控制龋病及牙周病；2.余留牙的保留与拔除（B对），如松动牙、残根、根分叉病变牙及其他情况的处理；3.修复前正畸治疗（E对）；4.咬合调整与选磨；5.临床牙冠延长；6.口腔黏膜疾患的治疗；7.修复前外科处理，即口腔软组织及牙槽骨的处理（C对）。